正中神经支配
A. 全部鱼际肌
B. 全部前臂前群肌
C. 前臂后群肌
D. 桡侧两块蚓状肌
E. 尺侧两块蚓状肌

正确答案：D。桡侧两块蚓状肌

解析：正中神经支配除拇收肌以为的鱼际肌（A错），在前臂正中神经支配除肱桡肌、尺侧腕屈肌和指深屈肌尺侧半以外的所有前臂屈肌和旋前肌（BC错），其在手部支配桡侧两块蚓状肌（D对E错）。